不与肾前面相毗邻
A. 肾上腺
B. 十二指肠
C. 胰尾
D. 结肠
E. 肝

正确答案：A。肾上腺

解析：肾上腺位于肾的上方，不与肾前面相毗邻（A错，为本题正确答案），与肾前面相毗邻的结构有胃底后面、胰尾（C对）和脾血管、空肠和结肠左曲、结肠右曲（D对）、十二指肠（B对）降部、肝（E对）等。